上述选项适用于阴胜的治法是
A. 寒者热之
B. 热者寒之
C. 阴病治阳
D. 阳病治阴
E. 阴中求阳

正确答案：A。寒者热之

解析：阴偏胜，即是阴盛，指机体在疾病过程中所出现的阴邪偏盛功能抑制机体反应性减弱而产生寒象的病机变化，可见恶寒，喜暖，口淡不渴，苔白，脉紧或迟等症状。阴盛的病机特点为阴盛而阳未虚，临床表现以实寒证为主；若阴盛伤及阳气，可兼有脘腹冷痛，溲清，便溏等表现，即所谓“阴盛则寒”“阴盛则阳”。所以在临床治疗时要用温热的方药治疗。寒证有表寒，里寒之别。治表寒证，宜用辛温解表的汗法，以发散风寒；治里寒证则用温中祛寒，回阳救逆等温法，以祛寒温里（A对）。